恶性肿瘤种植性转移到盆腔，最多见的是
A. 胃癌
B. 肝癌
C. 胰腺癌
D. 胆管癌
E. 胆囊癌

正确答案：A。胃癌

解析：在种植性转移到腹腔的恶性肿瘤中，最多见是胃癌（A对），胃癌侵及浆膜后，可种植到盆腔器官如卵巢等处。肝癌（P215）（B错）最常见肝内转移，只有当癌肿坏死、出血、破裂后才可能转移到盆腔，种植性转移到盆腔的发生率较胃癌小，故应排除。胰腺癌（P216）（C错）多经过门脉系统向肝内转移，而极少发生盆腔种植性转移，故应排除。胆管癌（外科学P470）（D错）主要向周围组织浸润，而极少发生盆腔种植性转移，故应排除。胆囊癌（外科学P468）（E错）多侵及胆囊周围淋巴，而极少发生盆腔种植性转移，故应排出。